糖皮质激素临床用于治疗
A. 胃溃疡
B. 低血压
C. 支气管哮喘
D. 肺结核
E. 糖尿病

正确答案：C。支气管哮喘

解析：本题考查糖皮质激素类平喘药。糖皮质激素有较强的抗炎抗变态反应，广泛应用于支气管哮喘治疗中（C对）。